不属于麻子仁丸组成药物的是
A. 芍药
B. 杏仁
C. 大黄
D. 厚朴
E. 甘草

正确答案：E。甘草

解析：本题考查方剂的组成，记忆即可。麻子仁丸的药物组成：麻子仁、芍药、枳实、大黄、厚朴、杏仁，没有甘草（E对）。记忆：麻子仁杏少（芍），大黄之（枳）后（厚）蜜。